活体组织检查标本应用哪种溶液固定
A. 70％乙醇
B. 2％枸橼酸
C. 2％碘酊
D. 4％甲醛
E. 5％新洁尔灭

正确答案：D。4％甲醛

解析：本题考查活体组织检查标本的固定溶液。活组织检查是从病变部位取一小块组织制成切片，通过适当染色后，在显微镜下观察细胞的形态和结构，以确定病变性质、肿瘤类型及分化程度的检查方法。送做活体组织检查的标本必须新鲜，不能自溶腐败，离体的标本应立即预以固定，常用4％甲醛（D对）固定，也可用95％酒精（A错）固定。固定液的量要充足，容器要密封，以保证固定效果。还应注意不宜用染料类固定液，2％枸橼酸（淡黄色）（B错）、5％新洁尔灭（黄色）（E错）、2％碘酊（红棕色）（C错）不应采用，以免肿瘤细胞变形或着色而影响诊断。